淋巴细胞活化过程中需要粘附分子的辅佐，其中能增强对肿瘤识别杀伤活性及协助Th活化B细胞的是
A. CD2/LFA-3
B. CD28/B7
C. LFA-1/ICAM-1
D. CD4/MHC-Ⅱ
E. CD8/MHC-1

正确答案：B。CD28/B7

解析：Th细胞表面的CD28和B细胞表面的B7相互作用都产生B细胞活化的第二信号。此外，Th2细胞也通过分泌IL-4和IL-5等细胞因子向B细胞传递激活信号。掌握“B细胞、T细胞介导的免疫应答”知识点。